甲减的精神症状很少表现为
A. 情感平淡
B. 情绪低落
C. 精神运动性抑制
D. 精神运动性不安
E. 幻觉妄想

正确答案：D。精神运动性不安

解析：甲减精神症状主要表现为：①情感平淡（A对）或情感淡漠；②抑郁综合征：如情绪低落（B对）、思维迟缓、注意力不集中等。患者的思维、情感和行为抑制尤为突出，患者的反应性、警觉性下降，严重者可以出现木僵（精神运动性抑制）（C对）；③幻觉、妄想等精神病性症状（E对）；④智能障碍；⑤粘液水肿性昏迷 。精神运动性不安少见（D错，为本题正确答案）。